T细胞介导的免疫应答包括的几个阶段是
A. T细胞特异性识别抗原阶段
B. T细胞活化、增殖和分化阶段
C. 效应T细胞的产生及效应阶段
D. 上列A和B两项
E. 上列A、B和C三项

正确答案：E。上列A、B和C三项